用于判断老年患者潜在不适当用药的是
A. 数字评分法
B. CTP评分标准
C. Cochrane证据分级
D. APACHE评分系统
E. Beers标准

正确答案：E。Beers标准

解析：本题考查老年人用药。Beers标准（E对）可用于判断老年患者潜在不适当用药。数字评分法（A错）可代表不同的疼痛。Child–Turcotte－Pugh（CTP）（B错）评分可作为肝功能不全分级的评估系统。Cochrane（C错）为循证医学的证据分级。APACHE评分系统（D错）在最新版大纲指导中未明确要求。